功能泻水逐饮、消肿散结的药物是
A. 大黄
B. 芒硝
C. 甘遂
D. 巴豆
E. 牵牛子

正确答案：C。甘遂

解析：本题考查的是甘遂的功效。功能泻水逐饮、消肿散结的药物是甘遂（C对）。甘遂：【功效】泻水逐饮，消肿散结。大黄（A错）：【功效】泻下攻积，清热泻火，解毒止血，活血祛瘀。芒硝（B错）：【功效】泻下，软坚，清热，回乳（外用）。巴豆（D错）：【功效】泻下冷积，逐水退肿，祛痰利咽，蚀疮去腐。牵牛子（E错）：【功效】泻下，逐水，去积，杀虫。